揭示人群中疾病的分布现象
A. 描述流行病学
B. 理论流行病学
C. 实验流行病学
D. 分析流行病学
E. 病例对照研究

正确答案：A。描述流行病学

解析：描述流行病学：主要是揭示人群中疾病或健康状况的分布现象。掌握“流行病学概论”知识点。